为换算采样的标准体积，在采样时必须测定的气象因素是
A. 气温、气压
B. 气温、气湿
C. 气温、气流
D. 气湿、气流
E. 气湿、气压

正确答案：A。气温、气压

解析：本题考查采样时测定的气象因素。为换算采样的标准体积，在采样时必须测定的气象因素是气温、气压（A对BCDE错）。